有关无症状性脑梗死的描述中不正确的是
A. 无明显体征
B. 病因多是动脉粥样硬化
C. 多位于非功能区
D. MRI易见脑室旁的白质高信号
E. 有明显体征

正确答案：E。有明显体征

解析：无症状脑梗死，临床上无明显体征（A对），梗死多位于白质非功能区（CD对），查体无神经系统定位体征，脑CT扫描、脑MRI检查发现有脑梗死病灶。无症状脑梗死与脑梗死的危险因素大致相同，病因多为动脉粥样硬化（B对），无明显体征（E错，为本题正确选项）。